下列哪个部门负责承担建立的健全安全管理制度，检查、维护实验设施，设备，控制实验室感染的职责
A. 实验室的建设单位及其主管部门
B. 实验室的设立单位及其主管部门
C. 实验室的管理单位
D. 实验室的监管部门
E. 县级以上地方人民政府主管部门

正确答案：B。实验室的设立单位及其主管部门